患者，女，45岁。因持续的烧心和反酸就诊，诊断为胃食管反流病，宜选用的抑酸药物是
A. 雷尼替丁
B. 米索前列醇
C. 吉法酯
D. 乳酶生
E. 匹维溴铵

正确答案：A。雷尼替丁

解析：本题考查雷尼替丁。宜选用的抑酸药物是雷尼替丁（A对）。雷尼替丁为强效组胺H₂受体阻断剂，能有效抑制由进食、胃泌素、高血糖或迷走神经兴奋等刺激引起的胃酸分泌，尤其能抑制夜间基础胃酸分泌，降低胃酸、胃蛋白酶活性；米索前列醇（B错）是合成前列素E₁类似物，用于预防和治疗由非甾体抗炎药引起的十二指肠损伤；吉法酯（C错）用于胃及十二指肠溃疡、急慢性胃炎、胃酸过多、胃灼热、腹胀、消化不良、空肠溃疡及痉挛；乳酶生（D错）用于治疗消化不良，肠内异常发酵，小儿腹泻及小儿便秘等；匹维溴铵（E错）适用于以腹泻为主要症状的肠易激综合征者。